疑为维生素D缺乏性手足搐搦症患儿，做陶瑟征检查时，袖带的压力应维持在
A. 舒张压以下
B. 收缩压与舒张压之间
C. 收缩压以下
D. 舒张压以上
E. 收缩压以上

正确答案：B。收缩压与舒张压之间

解析：当血压维持在收缩压与舒张压之间，血压计袖带包裹上臂，5分钟之内该手出现痉挛症状，叫做陶瑟征阳性。因此疑为维生素D缺乏性手足搐搦症做陶瑟征检查时，袖带的压力应维持在收缩压与舒张压之间（B对）。